固有免疫细胞不具备的应答特点是
A. 直接识别病原体PAMP
B. 识别结合相应配体后，立即产生免疫应答
C. 经克隆扩增和分化后，迅速产生免疫效应
D. 没有免疫记忆功能，不能引起再次应答
E. 免疫应答维持时间较短

正确答案：C。经克隆扩增和分化后，迅速产生免疫效应